如何给老年人挑选一副合适的保健牙刷
A. 刷头不宜过大
B. 刷毛软而有弹性
C. 刷柄较扁而宽
D. 牙刷容易握持
E. 以上均包括

正确答案：E。以上均包括

解析：老年人要选择适合自己的保健牙刷。刷头不宜过大，刷毛软而有弹性，刷柄较扁而宽，容易握持。掌握“老年人口腔保健”知识点。